患者，男，62岁。高血压病史10年，既往有骨关节炎和血脂异常，轻度心功能不全。近期体检发现血压162/80mmHg，心率72次/分。该患者目前服用的药物除抗高血压药外有辛伐他汀、双氯芬酸、氨基葡萄糖、甲钴胺及碳酸钙D。该患者首选的降压联合用药方案是
A. 特拉唑嗪+氢氯噻嗪
B. 氨氯地平+氢氯噻嗪
C. 利血平+氨苯蝶啶
D. 硝酸甘油+美托洛尔
E. 美托洛尔+呋塞米

正确答案：B。氨氯地平+氢氯噻嗪

解析：本题考查联合用药。该患者首选的降压联合用药方案是氨氯地平+氢氯噻嗪（B对）。材料中患者62岁，近期体检发现血压162/80mmHg，为单纯收缩期高血压。CCB+利尿剂联合用药，为一线降压方案。